进口药品的注册检验的组织机构是
A. 国家药品监督管理局
B. 中国食品药品检定研究院
C. 省级药品监督管理部门
D. 省级工商行政管理部门

正确答案：B。中国食品药品检定研究院

解析：本题考查的是中国食品药品检定研究院的主要职责。进口药品的注册检验的组织机构是中国食品药品检定研究院（B对）。中国食品药品检定研究院（国家药品监督管理局医疗器械标准管理中心，中国药品检验总所）：中国食品药品检定研究院的前身系中国药品生物制品检定所，最初是由原中央人民政府卫生部药物食品检验所和生物制品检定所于1961年合并成立的卫生部药品生物制品检定所，1986年更名为中国药品生物制品检定所，对外使用“中国药品检验总所”的名称，2010年9月26日更名为中国食品药品检定研究院，是国家药品监督管理局的直属事业单位，是国家检验药品、生物制品质量的法定机构。中国食品药品检定研究院的主要职责为：①承担食品、药品、医疗器械、化妆品及有关药用辅料、包装材料与容器（以下统称为食品药品）的检验检测工作。组织开展药品、医疗器械、化妆品抽验和质量分析工作。负责相关复验、技术仲裁。组织开展进口药品注册检验以及上市后有关数据收集分析等工作。②承担药品、医疗器械、化妆品质量标准、技术规范、技术要求、检验检测方法的制修订以及技术复核工作。组织开展检验检测新技术、新方法、新标准研究。承担相关产品严重不良反应、严重不良事件原因的实验研究工作。③负责医疗器械标准管理相关工作。④承担生物制品批签发相关工作。⑤承担化妆品安全技术评价工作。⑥组织开展有关国家标准物质的规划、计划、研究、制备、标定、分发和管理工作。⑦负责生产用菌毒种、细胞株的检定工作。承担医用标准菌毒种、细胞株的收集、鉴定、保存、分发和管理工作。⑧承担实验动物饲育、保种、供应和实验动物及相关产品的质量检测工作。⑨承担食品药品检验检测机构实验室间比对以及能力验证、考核与评价等技术工作。⑩负责研究生教育培养工作。⑪组织开展对食品药品相关单位质量检验检测工作的培训和技术指导。⑫开展食品药品检验检测国际（地区）交流与合作。药品监督管理部门是指依照法律法规的授权和相关规定，承担药品研制、生产、流通和使用环节监督管理职责的组织机构。国家药品监督管理局（A错）负责制定药品、医疗器械和化妆品监管制度，负责药品、医疗器械和化妆品研制环节的许可、检查和处罚。省级药品监督管理部门（C错）负责药品、医疗器械、化妆品生产环节的许可、检查和处罚，以及药品批发许可、零售连锁总部许可、互联网销售第三方平台备案及检查和处罚。市县两级市场监督管理部门负责药品零售、医疗器械经营的许可、检查和处罚，以及化妆品经营和药品、医疗器械使用环节质量的检查和处罚。